初产妇，27岁。妊娠40周，规律宫缩12小时。产科检查：胎头高浮，宫口开大3cm，胎头枕骨靠近骶岬，胎心140次/分。最恰当的处理措施是
A. 静脉滴注地诺前列酮
B. 尽早行剖宫产术
C. 等待宫口开全产钳助娩
D. 静脉滴注缩宫素
E. 等待经阴道分娩

正确答案：B。尽早行剖宫产术

解析：青年初产妇，妊娠40周（＞37周，已足月），规律宫缩12小时，宫口扩张3cm，胎头高浮，胎头枕骨靠近骶岬，确诊为高直后位，因此尽早行剖宫产术（B对CE错）。静脉滴注地诺前列酮（A错）（天然前列腺素）和静脉滴注缩宫素（D错）均能引起强烈宫缩，在胎头难以入盆时不能使用，可能导致胎儿窘迫甚至子宫破裂。